下列急性化脓性根尖周炎的症状中，不正确的叙述是
A. 自觉持续性跳痛
B. 患牙明显伸长
C. 咬紧牙时疼痛暂时缓解
D. 根尖区红肿、叩痛
E. 相应面部反应性水肿

正确答案：C。咬紧牙时疼痛暂时缓解

解析：本题考查急性化脓性根尖周炎。下列急性化脓性根尖周炎的症状中，不正确的叙述是咬紧牙时疼痛暂时缓解（C错，为本题的正确答案）。急性根尖周炎分为急性浆液性根尖周炎和急性化脓性根尖周炎两个阶段，急性化脓性根尖周炎又可分为根尖周脓肿、骨膜下脓肿、黏膜下脓肿三个阶段。在浆液期，主要症状为咬合痛，此阶段咬紧牙时疼痛暂时缓解，因为咬合的压力可暂时缓解局部血管的充血状态，使根尖周膜因组织水肿所形成的压力得到减轻；但是发展到化脓期，脓肿形成，牙周间隙内脓液积聚，压力升高，患牙会有明显浮出、伸长感（B对），自觉持续性跳痛（A对），此时咬合不仅不能缓解症状，反而咬合压力增加了根尖部组织的负担，引起更为剧烈的疼痛。根尖周脓肿阶段由于位置深在，根尖部无明显肿胀，扪诊感轻微疼痛；发展到骨膜下脓肿阶段，则表现为根尖区牙龈红肿明显、广泛，叩痛（D对）最为剧烈，严重的病例可在相应的颌面部出现蜂窝织炎，表现为软组织肿胀、压痛，致使相应面部反应性水肿（E对）；发展到黏膜下脓肿阶段，自发性胀痛和咬合痛随之减轻，根尖区牙龈仍然肿胀明显，但范围局限。